暴发型流脑的临床特点
A. 头痛腰痛眼眶痛
B. 高热惊厥休克呼吸衰竭
C. 心悸气促相对缓脉
D. 高热瘀斑休克呼吸衰竭
E. 发热皮疹脾大

正确答案：C。心悸气促相对缓脉

解析：暴发型流脑败血症休克型多见于儿童。突起高热，常在短期内全身出现广泛瘀点、瘀斑，且迅速融合成大片，皮下出血，或继以大片坏死。面色苍灰，唇周及指端发绀，四肢厥冷，心悸气促相对缓脉（C对），皮肤呈花纹，血压下降，甚至不可测出。脑膜刺激征缺如。脑脊液大多清亮，细胞数正常或轻度增加，血培养常为阳性。